输卵管妊娠最常见的部位是
A. 输卵管部
B. 输卵管峡部
C. 输卵管间质部
D. 输卵管间质部与峡部之间
E. 输卵管壶腹部

正确答案：E。输卵管壶腹部

解析：输卵管妊娠占异位妊娠的95％左右，其中壶腹部妊娠最多见，约占78％，其次为峡部、伞部，间质部妊娠较少见。掌握“异位妊娠”知识点。